危险度评定是指
A. 外来化合物自身具有的能导致机体损伤的能力
B. 化学物在一定接触条件下，对人体造成损害可能性的定量估计
C. 化学物在规定的使用方式和用量条件下，对人体健康不产生任何损害
D. 通过动物试验和对人群的观察，阐明某种外来化学物的毒性及其潜在危害
E. 以定量的概念，在人类接触环境有害因素后，对健康潜在损害的程度进行估测和鉴定

正确答案：D。通过动物试验和对人群的观察，阐明某种外来化学物的毒性及其潜在危害